用红外光谱法鉴别盐酸普鲁卡因，以下吸收峰的归属是：3315cm⁻¹,3200cm⁻¹
A. 氨基的vNH₂
B. 苯环的vC=C
C. 羰基的vC=O
D. 酯基的vC-O
E. 甲基的vC-H

正确答案：A。氨基的vNH₂